可作为治疗金黄色葡萄球菌引起的骨髓炎的首选药物的是
A. 林可霉素
B. 红霉素
C. 青霉素
D. 链霉素
E. 四环素

正确答案：A。林可霉素

解析：林可霉素主要用于厌氧菌感染，对金黄色葡萄球菌引起的骨髓炎为首选药。掌握“红霉素及林可霉素”知识点。